正常成年女性红细胞计数是
A. （4～10）×10⁹/L
B. （100～300）×10⁹/L
C. （1.0～3.0）×10¹²/L
D. （3.8～4.6）×10¹²/L
E. （4.5～5.5）×10¹²/L

正确答案：D。（3.8～4.6）×10¹²/L